境内申请人仿制境外上市但境内未上市原研药品的药品，按新的注册分类属于
A. 2类
B. 3类
C. 5类
D. 4类

正确答案：B。3类

解析：本题考查药品研制与生产管理-药品研制与注册管理-药品注册管理和审评审批制度改革。境内申请人仿制境外上市但境内未上市原研药品的药品，按新的注册分类属于3类（B对）。境外上市药品申请在境内上市，按新的注册分类属于5类（C错）。